男，30岁。因腹泻1天，于7月15日来诊，腹泻次数多不可数，为稀便和大量水样便，继之呕吐4次。尿少，无发热，无明显腹痛及里急后重。1周前往外地旅游，昨日归来。查体：T35.5℃，P120次/分，BP70/40mmHg，精神萎靡，烦躁，皮肤弹性差，口干，腹部凹陷，无肌紧张压痛及反跳痛，肠鸣音活跃。实验室检查：血WBC18×10⁹/L，Hbl70g/L粪常规检查：水样便，镜检WBC0～2/HP。为明确诊断，应首先进行检查是
A. 结肠镜检查
B. 血沉
C. 粪隐血
D. 粪便动力及制动试验
E. 血生化

正确答案：D。粪便动力及制动试验

解析：本病患者呕吐，腹泻次数多不可数，为稀便、水样便，尿少，血压低，精神萎靡，皮肤弹性差，口干，腹部凹陷（霍乱典型脱水及循环衰竭症状），血WBC18×10⁹/L（正常参考值4～10×10⁹/L），Hbl70g/L（正常参考值120～160g/L），粪常规检查：水样便，镜检WBC0～2/HP，结合临床表现和实验室检查应诊断为霍乱，粪便动力及制动试验（D对）可快速诊断。结肠镜检查（A错）、血沉（B错）、粪隐血（C错）均不是霍乱的检查方法，血生化（E错）是霍乱的一般检查，不能用于确诊。